沟纹舌的治疗应采用
A. 清除牙菌斑
B. 无症状者一般不需治疗
C. 去除残根残冠
D. 切除沟纹
E. 服用抗生素

正确答案：B。无症状者一般不需治疗

解析：沟纹舌若无疼痛可不治疗。应保持口腔清洁，用消炎漱口剂以防裂沟中食物残屑、细菌的滞留。掌握“地图舌、沟纹舌及舌乳头炎”知识点。